眼球
A. 角膜有丰富的神经末梢和毛细血管
B. 内膜呈棕黑色，故称色素膜
C. 内在肌均由副交感神经支配
D. 中膜分巩膜、虹膜、脉络膜3部分
E. 晶状体因疾病或创伤而变混浊称为白内障

正确答案：E。晶状体因疾病或创伤而变混浊称为白内障

解析：角膜有丰富的神经末梢，但无毛细血管（A错）；呈棕黑色，故称色素膜的是中膜，即眼球血管膜，而非内膜（B错）；眼球内在肌中，瞳孔开大肌由交感纤维支配，并非所有内在肌均由副交感神经支配（C错）；中膜（即眼球血管膜）分虹膜、睫状体和脉络膜3部分，而非巩膜、虹膜、脉络膜3部分（D错）；晶状体因疾病或创伤而变混浊称为白内障（E对）。